霍乱、副霍乱患者的大便性状为
A. 脓血便
B. 鲜血便
C. 粘液便
D. 米泔水样便
E. 白陶土样便

正确答案：D。米泔水样便

解析：霍乱是因摄入的食物或水受到霍乱弧菌污染而引起的一种急性腹泻性传染病，副霍乱是由霍乱弧菌古典生物型和艾尔托生物型所引起的烈性肠道传染病，这两种疾病患者的大便性状为米泔水样便（D对）。脓血便（A错）可见于直肠癌、结肠癌等。鲜血便（B错）可见于痔疮等。粘液便（C错）可见于肠易激综合征。白陶土样便（E错）可见于阻塞性黄疸。